直肠肛管周围脓肿最常见的发病部位是
A. 骨盆直肠间隙
B. 肛门周围皮下
C. 肛管括约肌间隙
D. 坐骨肛管间隙
E. 直肠壁内

正确答案：B。肛门周围皮下

解析：肛门周围皮下（48%）（B对）是直肠肛管周围脓肿最常见的发病部位。骨盆直肠间隙（A错）脓肿约占所有直肠肛管周围脓肿的2.5%，少见。肛管括约肌间隙（C错）脓肿、直肠壁内（E错）脓肿均极少见。坐骨肛管间隙（D错）脓肿约占所有直肠肛管周围脓肿的25%。